系统整理南北朝以前中药学资料的本草著作是
A. 《神农本草经》
B. 《雷公炮炙论》
C. 《本草经集注》
D. 《重修政和本草》
E. 《本草纲目》

正确答案：C。《本草经集注》

解析：本题考查的是主要本草典籍。系统整理南北朝以前中药学资料的本草著作是《本草经集注》（C对）。《本草经集注》：南朝·陶弘景（一作宏景，字通明，号华阳居士、华阳隐居、华阳真人）撰。成书于南北朝南齐永元二年（公元500年）之前。该书的主要成就包括：①全书7卷，是《本经》之后对我国中药学进行的又一次总结，系统整理了南北朝以前的药物学资料。②创立了新的编写体例：药物分类按自然属性进行区分，改进了《本经》三品分类法；所载药物内容采用朱墨、大小字体分书法，保持了引录文献的原有面貌。③创设了“诸病通用药”专项，以病证类药，利于临证遣药参考。④记载了对药物性能的认识，体现了对药性寒温程度有进一步认识。⑤记载了药物产地、形态与鉴别经验。⑥重视药物的炮制与配制前的加工。《神农本草经》（A错）：简称《本经》《本草经》《神农本草》。托名神农氏撰，约成书于东汉时期（公元25～219年），非一时一人所作。该书是最早的本草学专著，具有重要的科学价值和历史影响，为我国医药学四大经典著作之一。《雷公炮炙论》（B错）：南北朝刘宋时期雷敩编撰，全书3卷，是我国第一部炮制专著，第一次系统总结了前人炮制技术和经验，初步奠定了炮制学基础。《重修政和本草》（D错）：即为《重修政和经史证类备急本草》。刻板人张存惠，字魏卿，堂号晦明轩。全书共30卷，载药大约为1746张氏以《政和本草》（庞氏本）为基础，将《本草衍义》逐条散入，重新刊行。补充了《政和本草》原缺漏的由跋、鸢尾，改为今名，实为合刊本。种。该书为现存最早的完整的古本草合刊本。《本草纲目》（E错）：简称《纲目》，明·李时珍著，成书于1578年。此书可谓中药学巨著，内容广博，收罗繁富。全书引据历代本草凡84家，古今医书目277种，另从经史子集各部著作中引录了大量有关的文献资料，参考文献共计800余种。书中共收载药物1892种，方剂11096首，附有药物图谱1109幅。问世后被全部或部分译成日、朝、英、法、意、俄等多种文字。